为了增加甲硝唑溶解度，使用水-乙醇混合溶剂作为
A. 潜溶剂
B. 助悬剂
C. 防腐剂
D. 助溶剂
E. 增溶剂

正确答案：A。潜溶剂

解析：本题考查潜溶剂。为了增加甲硝唑溶解度，使用水-乙醇混合溶剂作为潜溶剂（A对）。潜溶剂系指能形成氢键以增加难溶性药物溶解度的混合溶剂；助悬剂（B错）是指能增加混悬剂中分散介质的黏度，降低药物微粒的沉降速度或增加微粒亲水性的附加剂；防腐剂（C错）指具有抑菌作用，能抑制微生物生长繁殖的物质；助溶剂（D错）是能增加药物在溶剂中溶解度的物质；增溶剂（E错）为具增溶能力的表面活性剂。